男性，36岁，被火焰烧伤2小时，估计深Ⅱ度面积15%，Ⅲ度面积25%，患者入院经清创、抗休克治疗，病情稳定。在焦痂处理过程中，患者突发寒战、体温39.8℃，高热不退3天，伴谵妄，尿少色清，白细胞计数升高，其并发症是
A. 补液反应
B. 药物过敏反应
C. 输血反应
D. 脓毒症
E. 毒血症

正确答案：D。脓毒症

解析：该患者在处理过程中发生了切痂后的寒战、高热、谵妄等全身性化脓感染症状，表现十分典型，是重度烧伤切痂后常见的并发症。掌握“火器伤、热烧伤”知识点。